月经周期长短取决于
A. 黄体退化为白体时间
B. 白体寿命长短
C. 增生期长短
D. 分泌期长短
E. 月经期长短

正确答案：C。增生期长短

解析：卵巢周期使子宫内膜发生周期性变化，根据子宫内膜的组织学变化，将月经周期分为月经期、增生期（与卵巢周期中的卵泡期相对应）和分泌期（与卵巢周期中的黄体期相对应）。分泌期（D错）即黄体期，时间固定在14天左右，月经期（E错）固定为月经周期的第1～4天，而卵泡期的时间长短变化很大，故月经周期的长短取决于卵泡期即增生期长短（C对）。若卵子未受精，黄体在排卵后9～10日开始退化，到第14日退化完全，并被纤维结缔组织所取代形成白体，黄体退化为白体的时间（A错）短暂而固定。白体（B错）是萎缩的黄体及替代的结缔组织，无功能无寿命，与月经周期无关。